不建议用于活髓牙修复体粘固的是
A. 磷酸锌水门汀
B. 氧化锌丁香油水门汀
C. 树脂水门汀
D. 玻璃离子水门汀
E. 聚羧酸锌水门汀

正确答案：A。磷酸锌水门汀

解析：本题考查修复体的粘固。不建议用于活髓牙修复体粘固的是磷酸锌水门汀（A对）。磷酸锌水门汀：是最早被使用的粘固材料，具有较高的抗压强度。粘固时的pH为3.5，由于这一酸性状态，磷酸锌水门汀一般被认为对牙髓有刺激作用。活髓牙不宜使用。